小儿五脏娇嫩，其中最突出的是
A. 肝、脾、肾
B. 肺、脾、肾
C. 心、肝、肾
D. 脾、心、肝
E. 心、肝、肺

正确答案：B。肺、脾、肾

解析：小儿需要维持正常的生理活动，而且处于生长发育阶段，所以小儿对肾气生发、脾气运化、肺气宣发的功能状况要求更高，因此，小儿在生长发育过程中会表现出肺脏娇嫩、脾常不足、肾常虚的特点（B对）。小儿心、肝虽同样未曾充盛，功能未健，不及肺、脾、肾突出（ACDE错）。